早期胃癌的概念是
A. 肿块直径在2cm以下
B. 只限于黏膜层
C. 未侵及肌层
D. 无淋巴结转移
E. 无远纵隔淋巴结转移

正确答案：C。未侵及肌层

解析：胃壁由内至外依次可分为黏膜层、黏膜下层、肌层和浆膜层共四层，早期胃癌指癌组织浸润局限于黏膜层或黏膜下层（C对B错），无论有无淋巴结转移（DE错），与癌组织的大小无关（A错）。